骨折线从鼻背、眶部，经颧骨上达翼突属于
A. LeFortⅠ型
B. LeFortⅡ型
C. LeFortⅢ型
D. 颅前窝骨折
E. 颅中窝骨折

正确答案：C。LeFortⅢ型

解析：本题考查上颌骨骨折的影像表现。骨折线从鼻背、眶部，经颧骨上达翼突属于LeFortⅢ型（C对）。LeFortⅢ型：骨折线横过鼻背、眶部，经颧骨上方达翼突。